“乙癸同源”的“乙癸”所指的脏是
A. 心脾
B. 肝肺
C. 脾肾
D. 心肾
E. 肝肾

正确答案：E。肝肾

解析：肝肾之间的关系极为密切，有“肝肾同源”、“精血同源”、“乙癸同源”之说。脏腑配属五行、天干，肝属乙木，肾属癸水，因此肝肾同源又称之为“乙癸同源”（E对），心脾、肝肺、脾肾、心肾在脏腑配属五行上不符（ABCD错）。